治疗慢性肾炎肾病型慢性肾功能不全，应首选
A. 低盐、低脂饮食，大黄保留灌肠
B. 低盐、低脂饮食，芒硝保留灌肠
C. 低盐、高脂饮食，大黄保留灌肠
D. 低盐、高热量饮食，芒硝保留灌肠
E. 低盐、高热量饮食，枳实保留灌肠

正确答案：A。低盐、低脂饮食，大黄保留灌肠

解析：在慢性肾功能不全早期开始饮食治疗，可减轻症状，延缓健存肾单位的破坏速度。给予蛋白饮食应个体化，避免营养不良的发生；高热量摄入可使低蛋白饮食的氮得到充分利用，减少体内蛋白质的分解消耗。有水肿、高血压和少尿表现的患者，要限制食盐的摄入，采用低盐、低脂饮食，可用大黄保留灌肠（A对）。不可给予高脂、高热量饮食，以防病情恶化，症状加重，芒硝、枳实灌肠不是其首选治法，故低盐、低脂饮食，芒硝保留灌肠（B错）；低盐、高脂饮食，大黄保留灌肠（C错）；低盐、高热量饮食，芒硝保留灌肠（D错）；低盐、高热量饮食，枳实保留灌肠（E错）均不是首选治疗。